男，59岁。慢性充血性心力衰竭患者，上呼吸道感染后喘憋加重，尿量减少，尿比重，1.020，尿钠18.6mmoI/L，SCr256μmol/L。少尿最主要的原因是
A. 急性间质性肾炎
B. 急性肾小管坏死
C. 肾后性急性肾衰竭
D. 急进性小球肾炎
E. 肾前性氮质血症

正确答案：E。肾前性氮质血症

解析：患者老年男性。慢性充血性心力衰竭患者，上呼吸道感染后喘憋加重（上呼吸道感染加重左心负荷，左心衰竭导致心排血量降低），尿量减少，尿比重，1.020（正常值1.015～1.025），尿钠18.6mmoI/L，SCr256μmol/L（正常值88.4～176.8μmol/L）（但尿比重正常，尿钠＜20mmoI/L，说明肾小管重吸收功能尚未受损），根据患者的原发病、尿液检测结果，考虑该患者少尿原因为肾前性氮质血症（E对）（P511）。急性间质性肾炎（A错）主要导致进行肾间质损伤，主要病因为药物、感染和自身免疫性疾病损伤肾间质，该患者没有相关病因，排除该项（P488）。急性肾小管坏死（B错）肾小管功能受损，尿比重降低，尿钠＞40mmoI/L，与该患者尿液检查不符，排除该项。肾后性急性肾衰竭（C错）源于急性尿路梗阻，常突发完全无尿或间歇无尿，该患者未提及结石、肿瘤或前列腺肥大等因素，排除该项。急进性肾小球肾炎（D错）一般有急性肾炎综合征表现，表现为血尿、蛋白尿、水肿、高血压，该患者无此类表现（P467）。